热邪壅肺证，可见
A. 咳嗽，咯痰稀白
B. 咳嗽，痰多泡沫
C. 咳喘，咯痰黄稠
D. 咳嗽，痰少难咯且喘
E. 痰多易咯

正确答案：C。咳喘，咯痰黄稠

解析：热邪壅肺，肺失清肃，气逆于上，故见咳喘；外邪犯肺，郁而化热，热伤肺津，炼液成痰，痰热交结，随气而逆，故见痰黄稠量多（C对）。咳嗽，咯痰稀白（A错）可见于风寒犯肺证，因寒邪阻肺，津凝不化所致。咳嗽，痰少难咯且喘（D错）可见于燥邪犯肺证，因燥邪犯肺，耗伤肺津所致。咳嗽，痰多泡沫（B错）可见于寒痰阻肺证，因寒邪阻肺，津凝不化所致。痰多易咯多属痰浊阻肺所致（E错）。